一旦人们的生活水平达到或超过起码需求，有条件决定生活资料的使用方式，对健康的作用越来越重要的是
A. 经济发展水平
B. 人口
C. 社会制度
D. 文化因素
E. 法律

正确答案：D。文化因素